女，19岁。以大量蛋白尿伴镜下血尿入院，体检：贫血貌，血压稍增高，血肌酐140μmol/L，血清补体C3降低，血清抗核抗体阳性，抗ds-DNA抗体阳性。下列病例最可能的诊断是
A. 急性链球菌感染后肾小球肾炎
B. 原发性肾病综合征
C. 紫癜性肾炎
D. 急进性肾炎
E. 狼疮性肾炎

正确答案：E。狼疮性肾炎

解析：青少年女性患者（SLE的好发人群），表现为大量蛋白尿伴镜下血尿，体查：贫血貌，血压稍增高。实验室检查：血肌酐140μmol/L（正常值（女）70～108μmol/L）（提示肾功能轻度受损），血清补体C3降低，血清抗核抗体阳性、抗ds-DNA抗体阳性（提示存在狼疮肾炎的可能）。根据患者临床表现及实验室检查，该患者最可能的诊断是狼疮性肾炎（E对）。狼疮肾炎是SLE的肾脏表现，好发于育龄期女性，肾脏表现多样，可表现为蛋白尿、血尿、管型尿、高血压及肾衰竭等，血清ANA、抗ds-DNA抗体、抗Sm抗体阳性可资鉴别。急性链球菌感染后肾小球肾炎（A错）多有前驱感染史，临床表现可与患者相似，C3可降低，但血清抗核抗体阳性，抗ds-DNA抗体阴性。原发性肾病综合征（B错）的必备诊断标准为大量蛋白尿及低蛋白血症，该患者不符合诊断，可排除。紫癜性肾炎（C错）是过敏性紫癜的对称性表现，常有前驱感染史或过敏原接触史，常见四肢对称性的紫癜，血清补体C3常升高，血清抗核抗体阳性，抗ds-DNA抗体阴性，因此，可排除诊断。急进性肾炎（D错）多在早期出现肾功能衰竭，血清抗核抗体阳性，抗ds-DNA抗体阴性，可排除诊断。